在食品中有毒有害物质限量标准的制定程序中，通过动物试验才能得出的是
A. 最大无作用剂量
B. 人体每日容许摄入量
C. 总膳食中的容许含量
D. 每种食物中的最大容许量
E. 食品中有毒物质限量

正确答案：A。最大无作用剂量